3095-96）》中规定，二级标准时可吸入颗粒物的日平均浓度限值为
A. 0.05mg/m³
B. 0.10mg/m³
C. 0.15mg/m³
D. 0.20mg/m³
E. 0.30mg/m³

正确答案：C。0.15mg/m³

解析：本题考查环境空气质量标准的相关内容。我国的《环境空气质量标准（GB 3095-96）》中规定，二级标准时可吸入颗粒物的日平均浓度限值为150μg/m³即0.15mg/m³（C对ABDE错）。